男性，37岁。左上尖牙外伤脱落再植固定后半年复诊。口腔检查：左上3牙体无明显变色，松动I°，叩诊（-），X线牙片示：左上3牙周间隙消失。此牙再植后发生的愈合方式属于
A. 牙周膜愈合
B. 骨性粘连
C. 炎症性牙根外吸收
D. 炎症性牙根内吸收
E. 牙脱落

正确答案：B。骨性粘连

解析：本题考查牙再植后的愈合方式。男性，37岁。左上尖牙外伤脱落再植固定后半年复诊。口腔检查：左上3牙体无明显变色，松动I°，叩诊（-），X线牙片示：左上3牙周间隙消失。此牙再植后发生的愈合方式属于骨性粘连（B对）。牙脱位再植后愈合的方式有三种：牙周膜愈合、骨性粘连和炎症性吸收。（1）骨性粘连表现为牙松动度减少，X线片示无牙周膜间隙，原因为牙根的牙骨质和牙本质被吸收并由骨质所代替，发生置换性吸收，从而使牙根和牙槽骨紧密相连。（2）牙周膜愈合即牙与牙槽之间形成正常牙周膜愈合，这种机会很少，仅限于牙脱位离体时间较短，牙周膜尚存活，而且又无感染者（A错）。（3）炎症性吸收X线片表现为广泛的骨透射区和牙根面吸收（CD错）。牙脱落说明牙再植失败，不属于牙再植的愈合方式（E错）。